男，35岁。田间耕作时被带锈铁钉刺伤右足，伤口约3cm，自行包扎未就医。6天后患者出现全身乏力，头晕，头痛，并觉张口困难，颈强直（+），头后仰，角弓反张。对造成该疾病的致病菌特点的描述，正确的是
A. 细菌形态为球菌
B. 致病菌素主要为内毒素
C. 感染必须具有缺氧环境
D. 革兰染色阴性
E. 芽胞对热、干燥不耐受

正确答案：C。感染必须具有缺氧环境

解析：患者中年男性，田间耕作时被带绣铁钉刺伤右足，伤口约3cm（破伤风梭菌感染的常见病因），自行包扎未就医（伤口错误处理）。6天后（破伤风潜伏期7天左右）患者出现全身乏力，头晕，头痛，并觉张口困难，颈强直（+），头后仰，角弓反张（破伤风的典型症状）。结合患者受伤史和症状，可诊断为破伤风。破伤风的致病菌破伤风梭菌（A错），为专性厌氧菌（C对），革兰染色阳性（D错），此菌对环境很强的抗力，可耐受高温和干燥环境（E错），破伤风梭菌芽孢在缺氧环境中，快速繁殖并产生大量的外毒素（B错），主要为痉挛毒素。